蛋白质-热能营养不良最先出现的症状是
A. 身髙低于正常
B. 皮下脂肪减少
C. 体重下降
D. 体重不增
E. 肌肉萎缩

正确答案：D。体重不增

解析：蛋白质－能量营养不良是由于缺乏能量和（或）蛋白质所致的一种营养缺乏症，组织生长消耗能量为儿童能量代谢的重要部分，当机体能量缺乏时机体动员脂肪供能，而体脂的变化首先影响体重，表现为体重不增（D对）。